分布于胸腹第二侧线的经脉是
A. 足太阴脾经
B. 足少阴肾经
C. 足阳明胃经
D. 足厥阴肝经
E. 足少阳胆经

正确答案：C。足阳明胃经

解析：本题考查各经脉的循行路线。足太阴脾经有一条分布于胸腹部第三条侧线，经锁骨下，止于腋下大包穴（A错）。足少阴肾经有分支向上行于腹部前正中线旁0.5寸，胸部前正中线旁2寸，止于锁骨下缘（B错）。足阳明胃经外行部分循行于胸腹第二侧线，抵腹股沟处，下循下肢外侧前缘（C对）。足厥阴肝经起于足大趾爪甲后丛毛处，沿足背向上至内踝前一寸处，向上沿胫骨内缘，在内踝上8寸处交出足太阴脾经之后，上行过膝内侧，沿大腿内侧中线进入阴毛中，绕阴器，注于肺中（D错）。足少阳胆经起于眼外角，向上到达额角部，下行至耳后，外折向上行，经额部至眉上，复返向耳后，再沿颈部侧面行于少阳三焦经之前，至肩上退后，交出于少阳三焦经之后，行入缺盆部。（E错）。记忆：在胸腹部由内向外依次是，任肾胃脾肝，趣记，人身为皮干。